关于药物制剂稳定性试验的说法，错误的是
A. 为药品生产、包装、贮存、运输条件提供科学依据
B. 通过试验建立药品的有效期
C. 影响因素试验包括高温试验、高湿试验和强光照射试验
D. 加速试验是在温度60℃±2℃和相对湿度75%±5%的条件下进行的
E. 长期试验是在接近药品的实际贮存条件下进行的

正确答案：D。加速试验是在温度60℃±2℃和相对湿度75%±5%的条件下进行的

解析：本题考查药物制剂稳定性试验。加速试验是在温度40℃±2℃和相对湿度75%±5%的条件下进行的（D错，为本题正确答案）。加速试验是在加速条件下进行，其目的是通过加速药物制剂的化学或物理变化，探讨药物制剂的稳定性，为处方设计、工艺改进、质量研究、包装改进、运输、贮存提供必要的资料。实验条件：温度40℃±2℃、相对湿度75%士5%的条件下放置6个月。检测包括初始和末次的3个时间点（如0、3、6个月）。稳定性试验的目的是考察原料药物或药物制剂在温度、湿度、光线的影响下随时间变化的规律，为药品的生产、包装、贮存、运输条件提供科学依据（A对），同时通过试验建立药品的有效期（B对）。稳定性试验包括影响因素试验、加速试验与长期试验。影响因素试验包括高温试验、高湿试验和强光照射试验（C对）。长期试验是在接近药品的实际贮存条件下进行（E对），其目的是为制订药品的有效期提供依据。